医生在器官移植问题上的道德责任，错误的是
A. 对活体的捐献，要保证供者的利他动机
B. 杜绝任何商业目的的器官移植活动
C. 对尸体捐献需要有亲属签订的知情同意书
D. 对器官分配应按医学与社会价值
E. 医生在被抢救的病人病故后，可立即摘取器官

正确答案：E。医生在被抢救的病人病故后，可立即摘取器官

解析：在尸体器官移植过程中，必须贯彻知情同意原则。如果死者生前并未表明要进行器官捐赠，则不能摘取死者器官第十版药理学（E错，为本题正确答案）。对活体捐献的规定，要求活体捐献人一般应与接受人在基因、法律或情感上有关系（A对）。原则规定了禁止通过商业性的方式征求器官（B对）。在摘取活体器官捐赠者捐赠的器官前，应当充分告知捐赠者及其家属摘取器官手术风险、术后注意事项、可能发生的并发症及预防措施等，并签署知情同意书（C对）。确保分配活动不仅考虑到了医疗因素，同时也顾及了社区价值和普遍伦理准则（D对）。